一条受污染河流中鱼类突然大量死亡，最常见原因
A. pH值异常
B. DO值过低
C. 有毒物存在
D. 有病原物存在
E. 缺少营养物质

正确答案：B。DO值过低

解析：本题考查溶解氧的相关内容。溶解氧（DO）含量可作为评价水体受有机性污染及其自净程度的间接指标。我国的河流、湖泊、水库水的溶解氧含量多高于4mg/L，有的可达6～8mg/L。当水中溶解氧小于3～4mg/L时（B对ACDE错），鱼类就难以生存。